表示抗菌药物抗菌活性的主要指标是
A. 抗菌谱
B. 化疗指数
C. 最低抑菌或杀菌浓度
D. 安全系数
E. 效价强度

正确答案：C。最低抑菌或杀菌浓度

解析：本题考查抗菌活性的定义。抗菌活性指抗菌药物抑制或杀灭病原菌的能力。能抑制培养基内细菌生长的最低浓度称最低抑菌浓度（MIC），能够杀灭培养基内细菌（即杀死99.9%供试微生物）的浓度为最小杀菌浓度，两者是药物抗菌活性指标（C对）。